女，22岁，腹痛伴频繁呕吐三天，以肠梗阻收入院，血Na⁺133mmol/L，血K⁺3mmol/L，HCO₃⁻8mmol/L，BP80/60mmHg，治疗应首先采取
A. 纠正酸中毒
B. 纠正低血钾
C. 纠正低血钠
D. 急诊手术，解除肠梗阻
E. 纠正低血容量

正确答案：E。纠正低血容量

解析：患者血压80/60mmHg，提示存在休克；血Na⁺133mmol/L（血钠浓度正常值为135～145mmol/L），提示存在低钠血症；HCO₃⁻8mmol/L（HCO₃⁻浓度正常值为22～27mmol/L），提示存在酸中毒；血K⁺3mmol/L（血钾浓度正常值为3.5～5.5mmol/L），提示存在低钾血症。该患者存在多种水、电解质及酸碱失调，应分轻重缓急，依次予以调整纠正。首先要处理的应该是纠正低血容量（E对），以保证循环状态良好，使患者脱离休克的危险状态。而后在纠正低血容量的前提下治疗原发病（D错），同时纠正水电解质及酸碱失调（ABC错）。